初产妇，25岁。确诊为急性乳腺炎。下列叙述错误的是
A. 全身应用抗生素
B. 饮食宜清淡，易消化，忌辛辣
C. 停止患侧哺乳，以吸乳器吸出乳汁
D. 炎症初期婴儿可以继续哺乳，推荐哺乳，喂奶前后应清洁乳头、婴儿的口腔及乳头周围
E. 已形成脓肿，应切开排脓，切口应包绕乳头呈环状

正确答案：E。已形成脓肿，应切开排脓，切口应包绕乳头呈环状

解析：乳腺炎炎症初期，患侧应停止哺乳，同时以吸乳器吸出乳汁（C对）。健侧可继续哺乳，以免影响婴儿生长及提供乳汁淤积的机会，喂奶前后应清洁乳头、婴儿的口腔及乳头周围（D对），避免再次感染。全身应用抗生素（A对），或局部注射在炎症病灶四周（七版黄家驷外科学P1152）。急性乳腺炎脓肿形成后，主要治疗措施是及时作脓肿切开引流。视脓肿部位不同，切口可为放射状、乳晕边缘弧形切口、乳房下缘弧形切口，因此不能武断地认为已形成脓肿，应切开排脓，切口应包绕乳头呈环状（E错，为本题正确答案）。急性乳腺炎饮食宜清淡，易消化，忌辛辣（B对）。